应激是机体受到各种内外环境因素刺激时所出现的一种
A. 特异性全身反应
B. 非特异性全身反应
C. 损害性全身反应
D. 代偿性全身反应
E. 防御性全身反应

正确答案：B。非特异性全身反应

解析：应激是机体受到各种内外环境因素刺激时所出现的一种非特异性全身反应（B对）。